有5类内分泌细胞，能分泌7种不同激索的内分泌器官是
A. 下丘脑
B. 腺垂体
C. 甲状腺
D. 肾上腺
E. 松果体

正确答案：B。腺垂体